可以抑制细菌核糖体50s亚单位，阻碍细菌蛋白质合成的抗菌药物有
A. 林可霉素类
B. 大环内酯类
C. 头孢菌素类
D. 酰胺醇类（氯霉素）
E. 氨基糖苷类

正确答案：A、B、D。林可霉素类；大环内酯类；酰胺醇类（氯霉素）

解析：本题考查抗菌药物。可以抑制细菌核糖体50s亚单位，阻碍细菌蛋白质合成的抗菌药物有林可霉素类（A对）、大环内酯类（B对）、酰胺醇类（氯霉素）（D对）。头孢菌素类（C错）抗菌药主要是通过与细菌细胞内膜上主要的青霉素结合蛋白结合，抑制细菌细胞壁合成，细菌溶菌死亡。氨基糖苷类（E错）抗菌药是与细菌核糖体的30S亚基结合。